既祛风湿，又清热解毒的是
A. 防己
B. 桑枝
C. 臭梧桐
D. 豨莶草
E. 青风藤

正确答案：D。豨莶草

解析：本题考查的是豨莶草的功效。既祛风湿，又清热解毒的是豨莶草（D对）。豨莶草：【功效】祛风湿，通经络，清热解毒，降血压。防己（A错）：【功效】祛风湿，止痛，利水。桑枝（B错）：【功效】祛风通络，利水。臭梧桐（C错）：【功效】祛风湿，通经络，降血压。青风藤（E错）：【功效】祛风湿，通经络，利小便。